可摘局部义齿人工后牙（牙合）面颊舌径在什么情况下应比真牙窄
A. 在任何情况下
B. 对颌为真牙
C. 对颌牙槽嵴吸收严重
D. 缺牙区牙槽嵴吸收较多
E. 缺失牙数目较少

正确答案：A。在任何情况下

解析：本题考查人工后牙的选择原则。任何情况下，在选择人工后牙时，人工牙的颊舌径应比真牙略窄，以减轻支持组织的负荷。减小人工牙面的颊舌径，加宽支托，使（牙合）面功能尖到支托连线的距离缩短，即缩小了（牙合）力力矩。这样既可有效地防止义齿发生旋转、摆动等义齿不稳定因素，又有效地保护了支持组织的健康（A对）。对颌为真牙（B错）、对颌牙槽嵴吸收严重（C错）、缺牙区牙槽嵴吸收较多（D错）、缺失牙数目较少（E错）虽正确但表述不全面，故排除。